心理生理障碍，又称心身疾病，是指
A. 与心理因素密切相关，以精神症状表现为主的疾病
B. 一个与社会因素密切相关以精神症状表现为主的疾病
C. 一组与心理因素密切相关以躯体症状表现为主的疾病
D. 一组与心理社会因素密切相关，躯体症状表现为主的疾病
E. 一个与心理社会因素相关以躯体症状表现为主的疾病

正确答案：D。一组与心理社会因素密切相关，躯体症状表现为主的疾病

解析：心理生理障碍是指一组与心理社会因素（C错）密切相关，躯体症状表现为主的疾病（D对），是躯体器质性疾病和功能性障碍而非精神症状表现（AB错），是一组而非一个（E错）。